女，45岁，双手近端指间关节，双腕和双踝肿痛5个月。查体：双手近端指间关节梭形肿胀；压痛（+），实验室检查：ESR45mm/h，RF阳性，抗环瓜氨酸肽抗体阳性。控制病情进展首选的药物是
A. 甲氨蝶呤
B. 布洛芬
C. 阿司匹林
D. 环磷酰胺
E. 泼尼松

正确答案：A。甲氨蝶呤

解析：中年女性患者（类风湿关节炎好发人群），双手近端指间关节，双腕和双踝肿痛5个月。查体：双手近端指间关节梭形肿胀，压痛（+）（类风湿关节炎常见表现），ESR45mm/h（血沉正常值男性0-10mm/h），RF阳性，抗环瓜氨酸肽抗体（CCP抗体）阳性（对于类风湿关节炎诊断特异性高），根据患者临床表现、查体及实验室检查，可诊断为类风湿性关节炎。类风湿性关节炎首选用药为甲氨蝶呤（MTX）（A对），可改善病情，控制病情进展。非甾体抗炎药（布洛芬（B错）、阿司匹林（C错）等）具镇痛抗炎作用，是改善关节炎症状的常用药，但不能控制病情。环磷酰胺（D错）是烷化剂类抗肿瘤药，不属于抗风湿药。糖皮质激素（泼尼松（E错）、地塞米松）具有强大的抗炎作用，不作为类风湿性关节炎首选用药。